全口义齿试戴时，下列方法可以判断垂直距离是否正确，除了
A. 患者戴入义齿后，是否不敢张口
B. 面部比例是否自然协调
C. 鼻唇沟，颏唇沟深度是否合适
D. 说话时上下牙有否碰击声
E. 患者发“S”音是否有困难

正确答案：A。患者戴入义齿后，是否不敢张口

解析：本题考查判断垂直距离是否正确的方法。患者戴入义齿后，不敢张口（A错，为本题的正确答案）说明张口时义齿会松动或脱落，这是检查义齿固位力的一个方法，与判断垂直距离无关。垂直距离是自然牙列呈正中（牙合）时鼻底到颏底的距离，也就是面下1/3的距离。面部比例自然协调（B对）说明面下1/3的距离恢复的合适；如果恢复的过高，表现为面下1/3的距离增大，颏唇沟变浅（C对），颏部皮肤呈皱缩状，说话和进食时会出现后牙相撞声（D对）且会影响发音清晰度（E对）；如果恢复的过低，表现为面下1/3的距离减小，唇红部显窄，口角下垂，鼻唇沟变浅，颏部变浅。发齿音s、ch时，上下前牙切缘接近，位置异常，如下前牙过于偏舌侧，覆盖过大，垂直距离过高或过低（息止牙合间隙过小或过大），或因人工后牙排列过于偏舌侧，舌侧基托过后等，均可会影响发音清晰度（E对）。